成人股骨干骨折，并有足背及胫前动脉搏动细弱，其首选的治疗方法是
A. 下肢皮牵引
B. 下肢骨牵引
C. 切开复位内固定
D. 手法复位夹板外固定
E. 手法复位石膏外固定

正确答案：C。切开复位内固定

解析：病人股骨干骨折，足背及胫前动脉搏动细弱，提示有动脉损伤出血，应立即行手术治疗（八版外科学P683），如切开复位内固定（C对）。垂直悬吊下肢皮肤牵引（A错）、持续胫骨结节或股骨踝上牵引（B错）、手法复位夹板外固定（D错）及手法复位石膏外固定（E错）均为股骨干骨折的非手术治疗措施。